儿童思维发展的重大转折时期是
A. 婴儿期
B. 幼儿期
C. 童年期
D. 学龄期
E. 青春期

正确答案：D。学龄期